根据下列血气分析结果，判断酸碱失衡的类型:PH:7.50，PaCO₂：13mmHg，HCO₃⁻：29mmol/L
A. 代谢性酸中毒合并呼吸性酸中毒
B. 代谢性酸中毒合并呼吸性碱中毒
C. 呼吸性酸中毒合并代谢性碱中毒
D. 呼吸性碱中毒合并代谢性碱中毒
E. 代谢性酸中毒合并代谢性碱中毒

正确答案：D。呼吸性碱中毒合并代谢性碱中毒

解析：PH:7.65>7.45表明为碱中毒，由于该患者PaCO₂（正常范围为33~46 mmHg）下降，HCO₃⁻（正常为22~27 mmoI/L）上升，两者变化方向相反，故可判断为酸碱一致型混合型酸碱平衡紊乱，即呼吸性碱中毒合并代谢性碱中毒（D对）。